患者，女，43岁，1周前右上第一前磨牙开始咀嚼痛，伴有右侧眶下区肿痛3天。检查见右眶下肿胀明显、右上第一前磨牙深龋，髓腔暴露，叩诊（+++），前庭沟肿胀，压痛，有波动感。此感染多来源于
A. 下颌磨牙的根尖周脓肿
B. 化脓性扁桃体炎
C. 下牙槽神经阻滞麻醉消毒不严
D. 化脓性中耳炎
E. 上颌尖牙及第一前磨牙或上颌切牙的根尖化脓性炎症

正确答案：E。上颌尖牙及第一前磨牙或上颌切牙的根尖化脓性炎症

解析：本题考查间隙感染概述、眶下间隙、咬肌间隙感染。眶下间隙感染多来自上颌尖牙及第一前磨牙或上颌切牙的根尖化脓性炎症或牙槽脓肿（E对）。此外，可因上颌骨骨髓炎的脓液穿破骨膜，或上唇底部与鼻侧的化脓性炎症扩散至眶下间隙。